CD4⁺Th1细胞诱导的炎症中最主要的效应细胞是
A. 活化的MΦ
B. T细胞
C. B细胞
D. NK细胞
E. 中性粒细胞

正确答案：A。活化的MΦ